喘证的病变部位在
A. 心、肺
B. 肺、肾
C. 心、肾
D. 脾、肾
E. 肺、脾

正确答案：B。肺、肾

解析：因肺为气之主，司呼吸，外合皮毛，内为五脏之华盖，为气机升降之枢纽。肺的宣肃功能正常，则吐浊吸清，呼吸调匀，肾主摄纳，有助于肺气肃降，故有“肺为气之主，肾为气之根”之说。若外邪侵袭，或它脏病气上犯，皆可使肺失宣降，肺气胀满，呼吸不利而致喘。如肺虚气失所主，亦可少气不足以息而为喘。肾为气之根，与肺同司气体之出纳，故肾元不固，摄纳失常则气不归原，阴阳不相接续，气逆于肺而为喘。另外，如脾经痰浊上扰，以及中气虚弱，土不生金，肺气不足；或肝气上逆乘肺，升多降少，均可致肺气上逆而为喘”（B对）(DE错）。只有当喘证进展至喘脱时才会累积心阳（AC错）。